适应性免疫应答的认识不正确的是
A. 特异性
B. 记忆性
C. 识别自己非己
D. 非特异性
E. 耐受性

正确答案：D。非特异性

解析：适应性免疫应答具有特异性、耐受性、记忆性，免疫耐受机制是免疫系统区别“自身”和“非己”的关键。掌握“基本概念”知识点。